和含牙囊肿来源一样的肿瘤
A. 萌出囊肿
B. 角化囊肿
C. 成軸细胞瘤
D. 根尖周囊肿
E. 鼻唇囊肿

正确答案：A。萌出囊肿

解析：本题考查萌出囊肿的来源。和含牙囊肿来源一样的是萌出囊肿（A对）。一般认为，牙源性囊肿的衬里上皮来源于牙源性上皮剩余，而不同囊肿可能来源于不同的上皮剩余：①牙板上皮剩余或Serres上皮剩余可发生发育性根侧囊肿和牙龈囊肿；②缩余釉上皮发生的囊肿有含牙囊肿、萌出囊肿以及炎性牙旁囊肿；③Malassez上皮剩余发生根尖周囊肿（D错）、残余囊肿和炎性根侧囊肿（BCE错）。